双肺满布湿啰音多见于
A. 肺结核空洞
B. 支气管扩张
C. 支气管肺炎
D. 肺瘀血
E. 急性肺水肿

正确答案：E。急性肺水肿

解析：湿啰音是由于吸气时气体通过呼吸道内的分泌物形成的水泡破裂所产生的声音。急性肺水肿（E对）时，肺间质液体集聚过多并侵入肺泡，肺含水量增加，双肺布满湿啰音。肺结核空洞（A错）、支气管扩张（B错）和支气管肺炎（C错）产生的都是局部湿啰音。肺淤血（D错）可以分为急性肺淤血和慢性肺淤血，急性肺淤血时，双肺可布满湿啰音，慢性肺淤血由于肺纤维化不出现此体征。